肺部支原体感染
A. 阿莫西林
B. 红霉素
C. 头孢曲松
D. 林可霉素
E. 万古霉素

正确答案：B。红霉素

解析：红霉素是治疗军团菌病、百日咳、空肠弯曲菌肠炎和支原体肺炎的首选药，也常用于感染厌氧菌引起的口腔感染，肺炎支原体、肺炎衣原体、溶脲脲原体等非典型病原体所致的呼吸及泌尿生殖系统感染。掌握“红霉素及林可霉素”知识点。